在急性呼吸性碱中毒起调节作用的主要是
A. 肺脏
B. 骨骼
C. 肝脏
D. 组织细胞
E. 肾脏

正确答案：D。组织细胞

解析：在急性呼吸性碱中毒起调节作用的主要是组织细胞（D对）。由于刺激肺通气过度的原因持续存在，肺（A错）的代偿调节作用就不明显，由于肾（E错）的调节作用发挥较慢，在急性碱中毒时作用也不明显。肝脏（C错）和骨骼（B错）都只在酸中毒中发挥作用。